能反映药物在体内吸收程度的参数是
A. Cmax
B. DF
C. MRT
D. AUMC
E. AUC

正确答案：E。AUC

解析：本题考查药动学参数。能反映药物在体内吸收程度的参数是血药浓度-时间曲线下面积（AUC）（E对）；单室模型血管外途径给药，血药浓度-时间关系为单峰曲线，在到达峰顶的时间称为达峰时间tmax，峰值为峰浓度Cmax（A错）；波动度（DF）（B错）是血药浓度波动程度的一种表示方法；平均滞留时间（MRT）（C错）是指所有药物分子在体内滞留的平均时间，即单次给药后所有药物分子在体内滞留时间的平均值；药-时曲线的一阶矩定义为时间与血药浓度的乘积-时间曲线下的面积（AUMC）（D错）。